人类能创造出“猪八戒”这一并不客观存在的文学形象，这恰好说明了
A. 心理是脑的功能
B. 心理是对客观现实的反映
C. 心理是极其复杂的
D. 心理是客观现实在人脑中的主观能动的反映
E. 动物进化中产生了神经结构这一物质基础之后才有了心理功能

正确答案：D。心理是客观现实在人脑中的主观能动的反映